小便短赤，溲时热涩刺痛者，治疗应选用
A. 玉女煎
B. 导赤散
C. 六一散
D. 黄连解毒汤
E. 竹叶石膏汤

正确答案：B。导赤散

解析：患者小便短赤，溲时热涩刺痛者。乃心经热盛移于小肠所致。方用导赤散。生地凉血滋阴以制心火，木通上清心经之火，下导小肠之热；竹叶清心除烦，淡渗利窍，导心火下行，生甘草清热解毒，调和诸药（B对）。玉女煎方证治少阴不足，阳明有余之证（A错）。六一散方证由暑邪夹湿所致（C错）。黄连解毒汤方证乃火毒充斥三焦所致（D错）。竹叶石膏汤方证乃热病后期，余热未清，气津两伤，胃气不和所致（E错）。趣记：牧童住草地导赤。木通竹草地导赤。